颞下颌关节紊乱病是口腔颌面部常见病之一，以下列哪一年龄组患病率、就诊率最高
A. 15岁以内
B. 20岁以内
C. 20～30岁
D. 40～50岁
E. 50岁以上

正确答案：C。20～30岁

解析：颞下颌关节紊乱病好发于青壮年，以20～30岁患病率、就诊率最高。颞下颌关节紊乱病并非指单一疾病，它是一类病因尚未完全清楚而又有相同或相似临床症状的一组疾病的总称。掌握“颞下颌关节紊乱”知识点。